菌斑细菌致龋的基础是
A. 糖代谢
B. 蛋白质代谢
C. 脂肪代谢
D. 无机盐代谢
E. 以上均是

正确答案：A。糖代谢

解析：本题考查牙菌斑生物膜的物质代谢。菌斑中的物质代谢包括糖代谢、蛋白质代谢和无机盐代谢。菌斑细菌致龋的基础是糖代谢（A对），蛋白质代谢（B错）、无机盐代谢（D错）可能对牙齿的各种成分造成影响，但不是最重要的。脂肪代谢（C错）属于机体内的代谢活动，不存在于菌斑的代谢活动中。